坎地沙坦酯是AⅡ受体拮抗剂，坎地沙坦酯在体内需要转化为坎地沙坦才能产生药物活性，体内半衰期为9小时，主要经肾排泄，坎地沙坦口服生物利用度为14%，坎地沙坦酯的口服生物利用度为42%，下列关于坎地沙坦酯的说法，正确的有
A. 坎地沙坦酯属于前药
B. 坎地沙坦不宜口服
C. 严重肾功能损害者慎用
D. 肝功能不全者不需要调整剂量
E. 坎地沙坦酯的分子中含有苯并咪唑结构

正确答案：A、B、C、E。坎地沙坦酯属于前药；坎地沙坦不宜口服；严重肾功能损害者慎用；坎地沙坦酯的分子中含有苯并咪唑结构

解析：本题考查坎地沙坦酯。坎地沙坦酯为含有苯并咪唑环的AⅡ受体拮抗剂（E对）。坎地沙坦酯是一个前药，在体内迅速并完全地代谢成活性化合物坎地沙坦（A对）。坎地沙坦不宜口服，坎地沙坦酯仅口服使用（B对）。有严重肾功能障碍的患者应慎重用药（C对）。有肝功能障碍的患者应从小剂量开始服用（D错）。